《中国药典》规定，可不进行溶化性检查的颗粒剂有
A. 混悬颗粒
B. 肠溶颗粒
C. 可溶颗粒
D. 泡腾颗粒
E. 缓释颗粒

正确答案：A、B、E。混悬颗粒；肠溶颗粒；缓释颗粒

解析：本题考查的是颗粒剂的质量要求。《中国药典》规定，可不进行溶化性检查的颗粒剂有悬颗粒（A对）、肠溶颗粒（B对）、缓释颗粒（E对）。颗粒剂的溶出度：除另有规定外，混悬颗粒剂应进行溶出度检查。颗粒剂的释放度：肠溶颗粒、缓释颗粒应进行释放度检查。颗粒剂的溶化性：可溶性颗粒（C错），取供试品10g（中药单剂量包装取1袋）加20倍量热水搅拌5分钟，可溶颗粒应全部溶化，允许有轻微混浊；泡腾颗粒（D错），取供试品3袋，分别置盛有200ml水的烧杯中，水温为15℃～25℃，应迅速产生气体而成泡腾状，5分钟内颗粒均应完全分散或溶解在水中。颗粒剂按上述方法检查，均不得有异物，中药颗粒还不得有焦屑。混悬颗粒以及已规定检查溶出度或释放度的颗粒剂可不进行溶化性检查。